心理危机干预首先应做的工作是
A. 组成若干干预小组
B. 迅速地普遍地开展心理咨询
C. 评估目标人群的心理健康状况
D. 把小学生先集中起来做心理辅导
E. 对各级干部进行心理知识培训

正确答案：C。评估目标人群的心理健康状况